男性，25岁，因口腔颌面部创伤致舌体裂伤，出血明显，口底肿胀，来院就诊，最佳的止血方法是
A. 注射止血针
B. 指压患侧的颈总动脉
C. 用纱布块填塞止血
D. 创口缝合止血
E. 做颈外动脉结扎术

正确答案：D。创口缝合止血

解析：本题考查口外手术组织切开、止血及组织分离。舌体是血液循环十分丰富的器官，裂伤后出血明显而且容易致口底肿胀或血肿造成上呼吸道梗阻，因此最佳处理是创口缝合止血（D对），其余方法如注射止血针（A错）、用纱布块填塞止血（C错）、指压患侧颈总动脉（B错）、颈外动脉结扎术（E错）均不是最有效方法。